预防MODS的基本要点中，错误的是
A. 重视诊治急重症时的整体观念
B. 重视病人循环呼吸
C. 防治感染
D. 积极改善全身状态
E. 及早治疗序贯继发的多个重要器官的功能障碍

正确答案：E。及早治疗序贯继发的多个重要器官的功能障碍

解析：MODS，即多器官功能衰竭（九版内科学P146）指机体在遭受急性严重感染、严重创伤、大面积烧伤等突然打击后，同时或先后出现2个或2个以上器官功能障碍，以至在无干预治疗的情况下不能维持内环境稳定的综合征。目前认为MODS为全身炎症反应的后续阶段，预防MODS即控制全身炎症反应不再恶化，应重视诊治急重症时的整体观念（A对），重视病人循环呼吸（B对），积极防治感染（C对），积极改善全身状态（D对）。及早治疗贯穿继发的多个脏器的功能障碍为MODS的治疗措施，并不能有效阻断疾病的发展、预防MODS的发生（E错，为本题正确选项）。